据《素问·举痛论》，怒则气
A. 下
B. 结
C. 上
D. 缓
E. 消

正确答案：C。上

解析：怒则气上句中的气，这里主要指肝气。肝气是喜畅达而恶抑郁。在正常情况下，肝气既不能抑郁，但又不宜过亢，同时，肝也是藏血的器官，如果精神受过度刺激，可使肝气过于升发而上逆，出现胸胁胀满，目赤，头痛，脉弦等症状，若肝血失藏，血随气升，则出现吐血症状（C对）。不同的情绪对于气机的变化有不同作用，恐则气下（A错），思则气结（B错），喜则气缓（D错），悲则气消（E对）。